慢性毒作用带（Zch）值越大的毒物引起
A. 慢性中毒的危险性越大
B. 慢性中毒的危险性越小
C. 蓄积中毒的危险性越小
D. 致死性中毒的危险性越大
E. 致死性中毒的危险性越小

正确答案：A。慢性中毒的危险性越大